切痂治疗烧伤，主要用于
A. Ⅰ度烧伤浅
B. Ⅱ度烧伤深
C. Ⅱ度烧伤Ⅲ度烧伤大面积烧伤
D. Ⅲ度烧伤大面积烧伤
E. 大面积烧伤

正确答案：D。Ⅲ度烧伤大面积烧伤

解析：Ⅲ度烧伤（D对）可外涂碘伏，保持焦痴干燥，防止感染。全身情况好者，于3～6日后分批多次切痂并植皮，或保痂开窗植皮。Ⅰ度烧伤（A错）、浅Ⅱ度烧伤（B错）、深Ⅱ度烧伤（C错）无痂皮生成，故不用切痂治疗。大面积烧伤（E错）过于概括，不知道烧伤深度，无法确定治疗方案。